能够杀灭各型阿米巴原虫，适用于肠内，外急慢性阿米巴病
A. 氯喹
B. 卡巴胂
C. 磷酸伯氨喹
D. 甲硝唑
E. 吐根碱

正确答案：D。甲硝唑

解析：硝基咪唑类药物如甲硝唑（D对）对阿米巴滋养体有强大的杀灭作用，是目前治疗肠内外各型阿米巴的首选药物。氯喹（A错）是目前非耐药疟疾的首选药物，具有高效、耐受性好、不良反应轻的优点，适宜成人使用。卡巴胂（B错）是一种人工合成的五价胂剂，能抑制虫体2巯基酶活性，能直接杀灭阿米巴滋养体。磷酸伯氨喹（C错）用于防治间日疟、三日疟的复发和传播，以及防止恶性疟的传播。吐根碱（E错）的盐酸盐对溶组织阿米巴滋养体有直接杀灭作用，可用于治疗急性阿米巴病。